女，24岁。腹痛、腹泻、便秘交替2年，大便糊状，脐周疼痛。近一年来消瘦、乏力、贫血。下午有时低热。对其有诊断意义的病理改变是
A. 肠腺隐窝脓肿
B. 炎性息肉
C. 肠瘘形成
D. 肠壁干酪性上皮样肉芽肿
E. 肠系膜淋巴结肿大

正确答案：D。肠壁干酪性上皮样肉芽肿

解析：青年患者，腹痛、腹泻、便秘交替2年，大便糊状，脐周疼痛，近一年来消瘦、乏力、贫血，下午有时低热，根据患者的病史、临床症状及体征，考虑最可能的诊断为肠结核，对其有诊断意义的病理改变有肠壁干酪性上皮样肉芽肿（D对）、裂隙溃疡、肠壁各层炎症。